以火（炸）药为动力发射的武器所造成的机体组织损伤统称为
A. 火器伤
B. 烧伤
C. 冷伤
D. 挤压伤
E. 冲击伤

正确答案：A。火器伤

解析：以火（炸）药为动力发射的武器所造成的机体组织损伤统称为火器伤。掌握“火器伤、热烧伤”知识点。